6岁男孩，摔倒时左手撑地，即出现左肘部疼痛肿胀，桡动脉搏动减弱。局部检查明显压痛，有骨摩擦音，肘前方可扪及骨折断端。最可能的诊断是
A. 桡骨头半脱位
B. 桡骨头骨折
C. 肱骨髁上骨折
D. 肱骨干骨折
E. 尺骨鹰嘴骨折

正确答案：C。肱骨髁上骨折

解析：患儿有左手撑地受伤史，左肘部疼痛肿胀、骨摩擦音，肘前方可扪及骨折断端，应考虑伸直型肱骨髁上骨折（C对）。桡骨头半脱位（A错）不会出现骨摩擦音（骨折特有体征）。桡骨头骨折（B错）、肱骨干骨折（D错）、尺骨鹰嘴骨折（E错）均不能在肘前方扪及骨折断端。